集中式给水适用于城镇和有相当数量人口的集体单位或农村居民点，其优点有以下几点，除了
A. 有利于水源的选择和防护
B. 较易保证水质
C. 水质如受污染，危害面积不大
D. 用水方便
E. 便于监督

正确答案：C。水质如受污染，危害面积不大

解析：本题考查集中式供水的优点。集中式供水是指由水源集中取水，经统一净化处理和消毒后，通过输配水管送到用户的供水方式。其优点是：有利于水源的选择和防护（A对）；易于采取改善水质的措施，保证水质良好（B对）；用水方便（D对）；便于卫生监督（E对）和管理，但水质一且被污染，其危害面亦广（C错，为本题正确答案）。